《素问·至真要大论》认为“诸暴强直”，病多属
A. 燥
B. 寒
C. 风
D. 热
E. 湿

正确答案：C。风

解析：诸暴强直，皆属于风（C对）本句意为多种发病急骤，突然出现筋脉拘挛、身体强直不能屈伸的病证，其病机大多属于风邪所致。这是因为风邪内袭，伤肝及筋，故多见颈项、躯干、四肢关节等出现拘急抽搐、强直不柔之症，风邪善行而数变，急暴突然为其致病特点。诸病水液，澄澈清冷，皆属于寒（B错）。诸胀腹大，皆属于热；诸病有声，鼓之如鼓，皆属于热；诸呕吐酸，暴注下迫，皆属于热（D错）。诸痉项强，皆属于湿（E错）。